传播是一种什么性质的传递信息的行为
A. 交换性
B. 互动性
C. 社会性
D. 传递性
E. 主观性

正确答案：C。社会性